下列缺失中，哪种宜于设计成混合支持式义齿（余留牙均健康，第三磨牙均存在）
A. |4567
B. 7654|4567
C. 8765|6
D. 65|7
E. 6|

正确答案：C。8765|6

解析：本题考查混合支持式义齿。8765|6（C对）宜于设计成混合支持式义齿（余留牙均健康，第三磨牙均存在）。混合支持式义齿适用于各类牙列缺损，尤其是游离端缺牙病例，在本题选项中只有8765|6为右上8游离端缺失。|4567（A错）、7654|4567（B错）的最后一个磨牙存在，且缺牙较多，可设计成黏膜支持式义齿。65|7（D错）、6|（E错）的最后一个磨牙存在，且缺牙较少，可设计成牙支持式义齿。